女性，32岁。饱餐后出现上腹剧痛伴恶心呕吐，吐后腹痛反而加重，服用解痉剂无效。检查：体温39℃，心率120次/分，多汗，上腹紧张，有压痛、反跳痛，血清淀粉酶320U/dl，血钙1.63mmol/L。应首先考虑的是
A. 急性心肌梗死
B. 溃疡病穿孔
C. 急性胰腺炎
D. 急性阑尾炎
E. 急性肠梗阻

正确答案：C。急性胰腺炎

解析：患者女性，饱餐（急性胰腺可由饱餐诱发）后出现上腹剧痛伴恶心呕吐，吐后腹痛反而加重（急性胰腺炎的疼痛吐后不缓解），服用解痉剂无效，检查见体温39℃（中等热度：38.1～39℃），心率120次/分（正常60～100次/分，提示心动过速），多汗，上腹紧张，有压痛、反跳痛（出现腹膜刺激征），血清淀粉酶320U/dl（正常60～120U/dl Somogyi法，增高主要见于急性胰腺炎），血钙1.63mmol/L（正常2.25～2.58mmol/L，小于2mmol/L提示病情严重），综合该患者的病史、体查、实验室检查，该患者诊断考虑为急性胰腺炎（C对）。急性心肌梗死（P244）（A错）疼痛位于胸骨后心前区，血清心肌酶升高，淀粉酶正常。溃疡病穿孔（P371）（B错）呈突发剧烈腹痛，查体见腹壁板样僵直，肝浊音界消失，患者往往有典型溃疡病史。急性阑尾炎（八版外科学P387）（D错）主要表现为转移性右下腹痛，压痛点位于固定位置。急性肠梗阻（八版外科学P374-P375）（E错）主要表现为腹部阵发性绞痛，肠鸣音亢进，排气排便停止，可见肠型和蠕动波。